收集资料是
A. 获得原始资料
B. 统计设计
C. 统计归纳，进行分组和汇总
D. 撰写文章
E. 计算统计指标，选择合适的检验方法并作出恰当的结论

正确答案：A。获得原始资料

解析：搜集资料是指选择得到资料的最佳途径和获取完整、准确、可靠资料的过程。资料的来源有统计报表（如年报表）、报告卡（传染病报告卡）、日常医疗卫生工作记录（如病历）、专题调查或实验等原始资料。掌握“统计基本概念和步骤”知识点。